患者因后牙有洞要求治疗。查：左下6（牙合）面龋，探稍敏，叩（-），冷测同对照牙，诊断为中龋，去腐后达牙本质中层，该牙的最佳处理为
A. 聚羧酸锌水门汀垫底，银汞合金充填
B. 磷酸锌水门汀垫底，银汞合金充填
C. 玻璃离子水门汀充填
D. 玻璃离子水门汀垫底，银汞合金充填
E. 氧化锌丁香油糊剂垫底，银汞合金充填

正确答案：A。聚羧酸锌水门汀垫底，银汞合金充填

解析：本题考查聚羧酸锌水门汀。患者因后牙有洞要求治疗。查：左下6（牙合）面龋，探稍敏，叩（-），冷测同对照牙，诊断为中龋，去腐后达牙本质中层，该牙的最佳处理为聚羧酸锌水门汀垫底，银汞合金充填（A对）。中龋窝洞充填时应先垫底再充填，银汞合金强度高，可用于后牙的充填修复；玻璃离子强度较低，牙体缺损修复时不适用于受力较大的部位，下6的牙合面承受的咀嚼力较大，不宜使用玻璃离子充填修复（C错）。聚羧酸锌可与金属修复体表面的金属离子产生化学反应，对金属修复体有较强的粘结作用，玻璃离子水门汀不会与银汞合金发生反应产生粘接作用，银汞合金充填时，用聚羧酸锌水门汀垫底，优于用玻璃离子水门汀垫底（A对D错）。磷酸锌水门汀充填时的酸性可刺激牙髓，不能用于直接垫底（B错）。氧化锌强度较低，不足以承受咀嚼压力，用于银汞合金充填垫底，在承受咀嚼压力时易折裂（E错）。